身热初按热甚，久按热反轻者多属
A. 热在表
B. 热在里
C. 虚阳外越
D. 阴虚证
E. 以上均不是

正确答案：A。热在表

解析：按肌肤的寒热可了解人体阴阳的盛衰、表里虚实和邪气的轻重。身热初按热甚，久按不热者，是热在表（A对）。若久按热愈甚者，为热在里（B错）。虚阳外越常见肌肤寒冷而大汗淋漓，面色苍白，脉微欲绝（C错）。